十二经脉中，多气多血之经是
A. 足厥阴肝经
B. 足太阳膀胱经
C. 手阳明大肠经
D. 足少阳胆经
E. 手少阴心经

正确答案：C。手阳明大肠经

解析：手阳明大肠经、足阳明胃经为多气多血之经（C对）。足厥阴肝经为多血少气之经（A错）。足太阳膀胱经为多血少气之经（B错）。手阳明大肠经为多气多血之经（C对）。足少阳胆经为多气少血之经（D错）。手少阴心经为多气少血之经（E错）。